男，50岁。因多年慢性肾衰竭准备行肾移植。因医院库存血液不足，需亲属献血给患者用。患者兄、妹各献血400ml，血液检测合格，拟供患者输注。此时应对这两袋血液采取的处理措施是
A. γ射线照射
B. 病毒灭活
C. 细菌灭活
D. 反复洗涤
E. 滤除白细胞

正确答案：A。γ射线照射

解析：患者接受兄妹的输血，供血中含有淋巴细胞的血液成分，应经γ射线辐照（A对）等物理方法去除免疫活性淋巴细胞。